男，32岁，右上臂刀割伤16小时，查体：T36.5℃，P80次/分，R18次/分，BP120/80mmHg，神志清楚，双肺呼吸音清，未闻及干湿啰音，心律齐，腹软，无压痛，右上臂外侧纵行伤口，长约4cm，边缘尚整齐。清创后，伤口不缝合，此时伤口内应放置的引流物是
A. 烟卷纱布
B. 生理盐水纱条
C. 硅胶管
D. 乳胶管
E. 乳胶片

正确答案：B。生理盐水纱条

解析：中年男性患者，右上臂刀割伤（属于一般开放性伤口）16小时，查体：T36.5℃（正常腋温36～37℃），P80次/分（正常60～100次/分），R18次/分（正常值12～20次/分），BP120/80mmHg（正常值90～120/60～80mmHg），神志清楚，双肺呼吸音清，未闻及干湿啰音，心律齐，腹软，无压痛，右上臂外侧纵行伤口，长约4cm，边缘尚整齐。开放性伤口常有污染，应行清创处理，目的在于将污染伤口变成清洁伤口，为组织愈合创造良好条件，清创应在伤后6～8小时进行，若伤口的处理时间已超过伤后8～12小时，但尚未发生明显感染，应在清创后，伤口内留置盐水沙条引流（B对），24-48小时后伤口仍无感染者，可缝线结扎、创缘对合，若发生感染则按感染伤口处理。烟卷纱布（A错），常作为软组织感染创面（如腹壁切口感染、脓性指头炎切开、掌中间隙脓肿切开、体表脓肿切开）的引流方法。而硅胶管（C错）、乳胶管（D错）等开放式或半开放式管道引流常作为预防性引流（如乳腺癌改良根治术）。乳胶片（E错）引流的适应证为创面少量渗血、渗液，引流时间宜短，浅表部位引流。